痰呈铁锈色最常见于
A. 肺炎链球菌肺炎
B. 肺炎支原体肺炎
C. 葡萄球菌肺炎
D. 肺炎克雷伯杆菌肺炎
E. 病毒性肺炎

正确答案：A。肺炎链球菌肺炎

解析：铁锈色痰是肺炎链球菌肺炎的特征性痰液表现（A对）。肺炎支原体肺炎（B错）可有阵发刺激性咳嗽，痰少，而无铁锈色痰。葡萄球菌肺炎（C错）为脓性痰和脓血性痰（P48）。肺炎克雷伯杆菌肺炎（D错）痰液特点为砖红色胶冻样痰。病毒性肺炎（E错）引起的是少量白色黏液痰（P51）。